频数分布集中位置偏向数值较小的一侧称为
A. 偏态分布
B. 不对称型分布
C. 对称分布
D. 正偏态分布
E. 负偏态分布

正确答案：D。正偏态分布

解析：本题考查偏态分布的相关内容。一般称这种有小部分数据偏大、直方图呈现右侧拖尾，同集中位置偏向数值较小一侧的非对称分布为正偏态（D对ABCE错）或右偏态。